下列与病人用药依从性无关的是
A. 药物的外观、口感和易识别使患者放心
B. 医师的关怀、体贴和对患者的责任心
C. 药师口头和书面用药指导的耐心
D. 护师给药操作和监护使患者安心
E. 国家卫生保健体制对群众的关心

正确答案：E。国家卫生保健体制对群众的关心